制剂处方中不含辅料的药品是
A. 维生素C泡腾颗粒
B. 蛇胆川贝散
C. 板蓝根颗粒
D. 元胡止痛滴丸
E. 利福昔明干混悬颗粒

正确答案：B。蛇胆川贝散

解析：本题考查蛇胆川贝散。制剂处方中不含辅料的药品是蛇胆川贝散（B对）。蛇胆川贝散中蛇胆汁和川贝母分别为液体和固体主药成分，制备时将干燥川贝母粉碎为细粉，与蛇胆汁吸附混匀，干燥粉碎过筛。维生素C泡腾颗粒（A错）中维生素C为主药，另加了泡腾崩解剂、着色剂、稀释剂、矫味剂等；板蓝根颗粒（C错）中板蓝根为主药，辅料有糊精、蔗糖；利福昔明干混悬颗粒（E错）辅料有微晶纤维素、果胶、蔗糖等。